过敏性结膜炎和春季卡他性结膜炎可选用
A. 色甘酸钠滴眼液
B. 七叶洋地黄双苷滴眼液
C. 玻璃酸钠滴眼液
D. 氧氟沙星滴眼液
E. 碘苷滴眼液

正确答案：A。色甘酸钠滴眼液

解析：本题考查治疗过敏性结膜炎和春季卡他性结膜炎的药物。色甘酸钠滴眼液（A对）可用于治疗过敏性结膜炎和春季卡他性结膜炎。对过敏性结膜炎可选用醋酸可的松、醋酸氢化可的松或色甘酸钠滴眼液和眼膏。春季卡他性结膜炎可应用2%色甘酸钠滴眼液。氧氟沙星滴眼液（D错）用于急性卡他性结膜炎未彻底治愈而转变为慢性结膜炎者，由细菌所致的结膜炎。碘苷滴眼液（E错）可用于治疗流行性结膜炎。玻璃酸钠滴眼液（C错）可用于干眼症。局部使用七叶洋地黄双苷滴眼液（B错）改善睫状肌功能和增加睫状肌血流量以改善眼部调节功能，减轻眼部不适。